对β-内酰胺类抗菌药物过敏的患者，Ⅰ类切口围术期预防应用抗菌药物时，可选用
A. 头孢唑林
B. 青霉素G
C. 氨曲南
D. 万古霉素
E. 克林霉素

正确答案：E。克林霉素

解析：本题考查围术期合理预防性应用抗菌药物。克林霉素（E对）是对β-内酰胺类抗菌药物过敏的患者，Ⅰ类切口围术期预防应用抗菌药物时，可选用的药物。头孢唑林（A错）可广泛用于耐青霉素类、对头孢唑林敏感的金黄色葡萄球菌感染。青霉素G（B错）为治疗敏感的革兰阳性菌、革兰阳性球菌及螺旋体感染（梅毒螺旋体）的首选药。氨曲南（C错）用于革兰阴性杆菌感染。万古霉素（D错）用于耐甲氧西林金黄色葡萄球菌（MRSA）。